表示单纯由于暴露引起或降低事件发生的危险性的大小
A. RR
B. AR
C. AR%
D. OR
E. PARP

正确答案：B。AR